视网膜中能感受强光和色觉的是
A. 视杆细胞
B. 视锥细胞
C. 双极细胞
D. 节细胞
E. 水平细胞

正确答案：B。视锥细胞

解析：视杆细胞（A错）能感受弱光刺激；视锥细胞（B对）能感受强光和色觉；双极细胞（C错）传递来自感光细胞的神经冲动；节细胞（D错）的轴突构成视神经。